下列关于噬菌体的叙述中，不恰当的一项是
A. 只含有一种核酸DNA或RNA
B. 可感染细菌、真菌、螺旋体和支原体
C. 对紫外线不敏感
D. 对理化因素的抵抗力比一般细菌的繁殖体强
E. 侵袭微生物的病毒

正确答案：C。对紫外线不敏感

解析：噬菌体是侵袭微生物的病毒，只含有一种核酸DNA或RNA，可感染细菌、真菌、螺旋体和支原体等。噬菌体对理化因素的抵抗力比一般细菌的繁殖体强，一般经75℃30分钟以上，才失去活性，对紫外线敏感。掌握“噬菌体性状及分类”知识点。